患者男性21岁，21外伤3年逐渐松动，检查：变色，Ⅲ°松动，根吸收1/2。此牙缺失后目前最佳修复方法为
A. 即刻牙再植
B. 延期牙再植
C. 牙种植
D. 异体牙移植
E. 烤瓷桥修复

正确答案：C。牙种植

解析：该患牙Ⅲ°松动，是拔除的适应症。牙种植（C对）是将替代天然牙的种植体植入颌骨，获取类似于牙固位支持的修复体。该患者是个别牙缺失，选择牙种植可获得足够固位力，又不会对邻牙造成任何损伤，从年龄上看，21岁身体自我恢复能力强，有利于获得骨结合界面，成功率高，所以牙种植是目前最佳修复方法。牙再植是牙外伤致使牙齿完全脱出后采用的治疗方法，一般因创伤脱位的牙、位置不正的单根扭转牙、误拔的正常牙，应选即刻牙再植（A错）；若受值区有严重感染，离体牙不宜立刻植入，需经一段时间治疗后方可植入，应选择延期牙再植（B错），该患者外伤没有导致牙齿完全脱出，不是牙再植的适应症。异体牙移植（D错）存在排斥问题，成功率不高，不推荐使用。烤瓷桥修复（E错）也不失为一个好方法，既美观，固位、强度也可，但是不可避免的要磨出健康邻牙作为固位体，相比牙种植，不是首选最佳方案。